片剂中常有的黏合剂有
A. 淀粉浆
B. HPC
C. CCNa
D. CMC-Na
E. L-HPC

正确答案：A、B、D。淀粉浆；HPC；CMC-Na

解析：本题考查片剂的常用辅料。淀粉浆（A对）、羟丙纤维素（HPC）（B对）、羧甲基纤维素钠（CMC-Na）（D对）均属于片剂的常用黏合剂。此外常用黏合剂还有乙基纤维素（EC）、聚维酮（PVP）、明胶、聚乙二醇（PEG）（E错）均为常用崩解剂。